氯丙嗪是
A. 治疗神经官能症的药物
B. 治疗精神分裂症的药物
C. 治疗躁狂症的药物
D. 治疗抑郁症的药物
E. 治疗焦虑症的药物

正确答案：B。治疗精神分裂症的药物

解析：丙嗪主要用于Ⅰ型精神分裂症（精神运动性兴奋和幻觉妄想为主）的治疗，尤其对急性患者疗效好。精神分裂症患者口服氯丙嗪后，能迅速控制兴奋躁动症状，连续服药后幻觉和妄想等症状也逐渐消失，理智恢复，情绪安定，生活能自理（B对）。